女，43岁，右下腹持续性疼痛5天，伴恶心呕吐，呕出物为胃内容物。体温38.5℃。体检发现右下腹5cm×5cm大小肿块，触痛明显如果急诊手术，最合适的手术方式是：
A. 脓肿引流
B. 切除肿块
C. 常规切除阑尾
D. 右半结肠切除
E. 一期肠吻合

正确答案：A。脓肿引流

解析：青年女性患者，右下腹持续疼痛（提示病变位于右下腹），伴恶心、呕吐，体温38.5℃（正常为36～37℃），体检发现右下腹有一包块，触痛明显，结合患者病史和体查，应诊断为阑尾周围脓肿。如果急诊手术，应以脓肿引流为主，不宜常规切除阑尾，否则易发生肠瘘、感染等并发症（A对C错）。阑尾周围脓肿直接行手术切除易继发腹腔感染，故一般不用（B错）。右半结肠切除术（D错）为右侧结肠癌的手术方式。阑尾周围脓肿急诊手术不需行肠切除术，故不需行一期肠吻合（E错）。